可替代氯霉素用于治疗伤寒的药物是
A. 四环素类
B. 氨基糖苷类
C. 青霉素类
D. 氟喹诺酮类
E. 大环内酯类

正确答案：D。氟喹诺酮类

解析：本题考查氟喹诺酮类抗菌药。氟喹诺酮类药（D对）诺氟沙星适用于敏感菌所引起的呼吸道、泌尿道、胃肠道感染，可替代氯霉素用于治疗伤寒。四环素类（A错）仅适用于少数敏感菌及衣原体属、立克次体等不典型病原体所致感染。氨基糖苷类（B错）抗需氧革兰阴性杆菌、假单胞菌属、结核菌属和葡萄菌属。青霉素类（C错）用于治疗由各种敏感菌引起的感染性炎症，不用于伤寒的治疗。大环内脂类（E错）用于治疗需氧革兰阳性球菌和阴性球菌、某些厌氧菌以及军团菌、支原体、衣原体等感染。